男，28岁，以前精神正常，到某地出差刚下火车，突然感到要爆发战争了，因为好多人都往出口处跑。最可能的症状是
A. 错觉
B. 幻觉
C. 感知综合障碍
D. 原发性妄想
E. 继发性妄想

正确答案：D。原发性妄想

解析：原发性妄想（D对）为突然发生，表现为内容不可理解，不能用既往经历、当前处境及其他心理活动等加以解释。患者以前精神正常，到某地出差刚下火车，突然感到要爆发战争了，因为好多人都往出口处跑，为典型的原发性妄想。错觉（A错）是对客观事物歪曲的知觉，临床上以错听和错视多见。幻觉（B错）是没有现实刺激作用于感觉器官时出现的知觉体验，是一种虚幻知觉。感知综合障碍（C错）指患者对客观事物的整体属性能够正确感知，但是对某些个别属性如大小、形状、颜色、距离、空间位置等产生错误的感知。继发性妄想（E错）是发生在其他病理心理基础上的妄想，或与某种经历、情境等有关的妄想。